关于硝苯地平，哪项错误
A. 是二氢吡啶类钙离子通道阻滞药
B. 口服吸收迅速而完全
C. 主要的不良反应是低血压
D. 可用于治疗心律失常
E. 可用于治疗高血压和心绞痛

正确答案：D。可用于治疗心律失常